轻度脱水第一天补液总量为
A. 50～90ml/kg
B. 180～250ml/kg
C. 150～180ml/kg
D. 90～120ml/kg
E. 120～150ml/kg

正确答案：D。90～120ml/kg

解析：补液总量包括补充累积损失量、继续损失量和生理需要量，一般轻度脱水约为90～120ml/kg、中度脱水约为120～150ml/kg、重度脱水约为150～180ml/kg，对少数营养不良，肺炎、心、肾功能不全者患儿尚应根据具体病情分别做较详细的计算。掌握“儿童营养基础”知识点。